经别的生理功能为
A. 总督一身阳气
B. 调节十二经脉气血
C. 分主一身左右之阴阳
D. 加强十二经脉表里两经在体表的联系
E. 加强十二经脉表里两经在体内的联系

正确答案：E。加强十二经脉表里两经在体内的联系

解析：十二经别加强十二经脉表里两经在体内的联系（E对），加强体表与体内、四肢与躯干的向心性联系，加强足三阴、足三阳经脉与心脏的联系，加强了十二经脉和头面部的联系，扩大十二经脉的主治范围。督脉具有统率一身之阳经，调节全身阳经气血的作用，故为“阳脉之海”（A错）。冲脉调节十二经脉气血（B错），与女子月经及生殖功能有关；阳跷主一身左右之阳，阴跷主一身左右之阴（C错）。十五别络加强十二经脉表里两经在体表的联系（D错），加强人体前、后、侧面联系，统率其他络脉，渗灌气血以濡养全身。